特有解剖标志是近中沟的是
A. 上颌第一前磨牙
B. 上颌第二前磨牙
C. 上颌第一磨牙
D. 下颌第一前磨牙
E. 下颌第一磨牙

正确答案：A。上颌第一前磨牙

解析：本题考查恒牙的解剖形态。特有解剖标志是近中沟的是上颌第一前磨牙（A对）。上颌第一前磨牙是前磨牙中唯一的颊尖偏向远中者，且近中沟是其特有的解剖标志。远中舌沟和斜嵴是上颌第一磨牙（C错）的解剖特征。下颌第一前磨牙（D错）可见横嵴和近中舌沟。下颌第一磨牙（E错）为恒牙中萌出最早的牙；是下颌牙弓中体积最大的牙；为（牙合）面尖、嵴、窝、沟、斜面最多的牙。